医生刘某看药品经营能挣钱，便与院领导拉关系，请假离岗搞药品销售，时间近三年。对刘某离岗二年以上的行为，医院应当报告准予注册的卫生行政部门的期限是
A. 离岗满2年的10日内
B. 离岗满2年的15日内
C. 离岗满2年的30日内
D. 离岗满2年后3个月内
E. 离岗近3年的当时

正确答案：C。离岗满2年的30日内